属于临产的标志是
A. 规律渐强式宫缩
B. 阴道流血
C. 胎儿下降感
D. 羊水早破
E. 不规则宫缩

正确答案：A。规律渐强式宫缩

解析：见红是指在临产前24～48小时内，因宫颈内口附近的胎膜与该处的子宫壁分离，毛细血管破裂有少量出血，与宫颈管内黏液栓相混并排出的现象。见红是分娩即将开始较可靠的征象，是先兆临产的表现之一，并不是临产的标志（B错）。临产开始的标志为规律且逐渐增强的子宫收缩（A对），胎儿下降感（C错）由于胎先露部下降、入盆衔接使宫底降低，孕妇自觉上腹部较前舒适。不规则宫缩又称假临产，分娩发动前，由于子宫肌层敏感性增强，可出现不规律宫缩（E错）。羊水早破（D错）不能判断临产。